下列有关桥体应具备的条件，说法错误的是
A. 化学性能稳定
B. 引导咀嚼时的侧方运动的方向
C. 有利于口腔硬软组织健康
D. 不利于基牙牙周组织的健康
E. 有良好的生物相容性

正确答案：D。不利于基牙牙周组织的健康

解析：桥体应具备的条件：①恢复缺失牙功能：桥体应能够恢复缺牙的形态和功能。如恢复缺失前牙的切割功能和语言发音清晰度。恢复后牙捣碎食物，引导咀嚼时的侧方运动的方向等功能；②自洁作用：桥体应有良好自洁作用，符合口腔卫生要求，有利口腔硬软组织健康；③形态和色泽：桥体应符合美观和舒适的要求，使外形近似缺失天然牙的形态与色泽；④减轻（牙合）力：后牙桥体的宽度和（牙合）面解剖形态等恢复，应能减轻基牙的负荷，有利基牙牙周组织的健康；⑤材料性能：桥体应有足够的机械强度，化学性能稳定和有良好的生物相容性。掌握“固定桥的设计”知识点。